定期健康检查的目的有
A. 早期发现对工人的健康损害，防止进一步发展
B. 早期发现新出现的禁忌证，发现工人是否适合从事某项工作
C. 了解患者病情发展情况
D. 为评价生产环境好坏提供资料
E. 为职业流行病学研究提供资料

正确答案：A。早期发现对工人的健康损害，防止进一步发展